在药品零售企业应按照处方药进行管理的泻药是
A. 甘油栓
B. 比沙可啶片
C. 乳果糖口服液
D. 聚乙二醇4000散剂
E. 酚酞片

正确答案：E。酚酞片

解析：本题考查泻药。在药品零售企业应按照处方药进行管理的泻药是酚酞片（E对）。缓泻药分为容积性、刺激性、润滑性和渗透性泻药。《国家非处方药目录》收载的缓泻药的活性成分有：乳果糖（C错）、比沙可啶（B错）、甘油（A错）、硫酸镁等；制剂有开塞露、聚乙二醇散剂（D错）等。处方药有酚酞、莫沙必利、普芦卡必利。